男性，50岁。腹泻年余，粪便稀便常常有不消化的食物，粪检（﹣），1年前曾因绞窄性肠梗阻做部分小肠切除术，腹泻的原因可能为
A. 胃泌素瘤
B. 甲状腺功能亢进
C. 霍乱
D. 吸收不良综合征
E. 急性胃肠炎

正确答案：D。吸收不良综合征